走行于大网膜前两层之间的动脉是
A. 胃左动脉
B. 胃网膜右动脉
C. 中结肠动脉
D. 肝固有动脉
E. 子宫动脉

正确答案：B。胃网膜右动脉

解析：胃网膜右动脉（B对）为走行于大网膜前两层之间的动脉，其终末支与胃网膜左动脉相吻合。